下列哪种变化属于晚期煤矽肺的典型表现
A. 煤斑
B. 煤斑旁肺气肿
C. 煤矽结节
D. 弥漫性纤维化
E. 大块纤维化

正确答案：E。大块纤维化